基因突变是指
A. 染色体数目与结构的改变
B. 易患某种疾病的素质
C. 基因的化学结构改变
D. 损伤胎儿生长发育的改变
E. 免疫功能的改变

正确答案：C。基因的化学结构改变

解析：通过改变DNA碱基顺序或碱基类型导致基因突变，是基因化学结构的改变（C对）。